基于局部麻醉药物改造得到的抗心律失常药是
A. 盐酸普鲁卡因胺
B. 奎尼丁
C. 多非利特
D. 盐酸普罗帕酮
E. 胺碘酮

正确答案：A。盐酸普鲁卡因胺

解析：本题考查抗心律失常药。盐酸普鲁卡因胺（A对）为局麻药普鲁卡因的衍生物，临床作为广谱的抗心律失常药。奎尼丁（B错）是从金鸡纳树皮中提炼得到的。多非利特（C错）、盐酸普罗帕酮（D错）、胺碘酮（E错）均是经过化学合成得到的，以上三种不是经局部麻醉药物改造而成。